痰浊中阻，胃失和降的临床表现是
A. 咳嗽痰多，胸闷
B. 神昏，喉中痰鸣
C. 形体肥胖
D. 脘痞纳呆
E. 肌肤见圆滑包块

正确答案：D。脘痞纳呆

解析：痰浊内停于肺，而影响肺气的宣发肃降，故痰证以咳吐痰多、胸闷为基本表现（A错）。痰可随气升降，流窜全身痰蒙心神则见神昏而喉中痰鸣（B错）。痰泛于肌肤，则见形体肥胖（C错）。痰浊中阻，胃失和降，可见脘痞、纳呆、泛恶呕吐痰涎等症（D对）。痰的流动性小而难以消散，故常凝积聚于某些局部而形成圆滑包块（E错）。